分层抽样能减少由各层特征不同而引起的抽样误差，为了对各层情况有清晰的了解，在不同层里抽样应做到
A. 比例必须相同
B. 比例可以不同
C. 人数必须相同
D. 年龄性别不必考虑
E. 疾病严重性不必考虑

正确答案：B。比例可以不同

解析：本题考查分层抽样的相关内容。分层抽样是指先将总体按某种特征分为若干次级总体（层），然后再从每一层内进行单纯随机抽样，组成一个样本。分层抽样又分为两类：一类叫按比例分配分层随机抽样，即各层内抽样比例相同；另一类叫最优分配分层随机抽样，即各层抽样比例不同，内部变异小的层抽样比例小，内部变异大的层抽样比例大，此时获得的样本均数或样本率的方差最小。为了对各层情况有清晰的了解，在不同层里抽样应做到抽样比例不同（B对ACDE错）。